小隐静脉注入
A. 股动脉
B. 大隐静脉
C. 腘静脉
D. 胫前静脉
E. 胫后静脉

正确答案：C。腘静脉

解析：小隐静脉在足外侧缘起自足背静脉弓，经腓肠肌两头之间上行，注入腘静脉（C对）。